易发生休克的骨折
A. 骨盆骨折
B. 肱骨髁上骨折
C. 股骨颈骨折
D. 锁骨骨折
E. Colles骨折

正确答案：A。骨盆骨折

解析：骨折后休克的主要原因是出血，骨盆各骨主要为松质骨，邻近有许多动静脉丛，血液供应丰富，故骨盆骨折可引起广泛出血，出血量多者可达2000ml以上，故易发生休克（A对）（通常在迅速失血超过全身总血量的20%时，即出现休克）。肱骨髁上骨折（B错）的出血量为50～400ml，一般不会引起休克；股骨颈骨折（C错）易发生股骨头缺血性坏死；锁骨骨折（D错）易损伤臂丛神经，出血量较少；Colles骨折（E错）为桡骨远端的伸直型骨，通常不会引起大出血致休克。